职业病诊断应当综合分析下列因素，但除外
A. 患者的职业史
B. 职业病危害接触史
C. 职业病现场危害调查与评价
D. 临床表现以及辅助检查结果
E. 患者的家族遗传病史

正确答案：E。患者的家族遗传病史